能够增加粪便体积和调节稠度，不从肠道吸收，不产气，不影响脂溶性维生素吸收的安全缓泻药是
A. 聚乙二醇粉
B. 乳果糖
C. 液状石蜡
D. 硫酸镁
E. 酚酞

正确答案：A。聚乙二醇粉

解析：本题考查缓泻药。能够增加粪便体积和调节稠度，不从肠道吸收，不产气，不影响脂溶性维生素吸收的安全缓泻药是聚乙二醇粉（A对）。乳果糖（B错）在结肠中被消化道菌丛转化成有机酸，并通过渗透作用增加粪便含水量，刺激结肠蠕动。液状石蜡（C错）不用于治疗便秘。硫酸镁（D错）在肠道不易吸收，但易导致脱水，不是安全缓泻药。酚酞（E错）主要作用于结肠，口服后在小肠碱性肠液的作用下慢慢分解。